协调医务人员之间关系的首要思想基础和道德要求是
A. 彼此信任、相互协作
B. 维护健康、救治生命
C. 彼此独立、相互支持
D. 彼此平等、相互尊重
E. 互相学习、共同提高

正确答案：B。维护健康、救治生命

解析：协调医务人员之间关系的首要思想基础和道德要求是维护健康，救治生命（B对）。平等待人和互相尊重是协调医务人员之间的关系，友好相处的基础。同时要遵循彼此独立，互相帮助原则，才能形成良好的人际关系，称为医疗人际关系和谐坚实的基础。彼此信任互相监督是协调医疗人际关系的基本要求。互相学习，共同提高才能发挥整体优势，把全心全意为患者服务的宗旨落到实处。